称为“阴脉之海”的经脉是
A. 带脉
B. 冲脉
C. 任脉
D. 督脉
E. 阴维脉

正确答案：C。任脉

解析：本题考查的是任脉的基本功能。称为“阴脉之海”的经脉是任脉（C对）。任脉的基本功能：（1）调节阴经气血，故称“阴脉之海”。（2）主持妊养胞胎。带脉（A错）的基本功能：（1）约束纵行诸经。（2）主司妇女的带下。冲脉（B错）的基本功能：（1）调节十二经气血，故称“十二经脉之海”。（2）冲为血海，有促进生殖之功能，并同妇女的月经有着密切的联系。督脉（D错）的基本功能：（1）调节阳经气血，故称“阳脉之海”。（2）与脑、髓和肾的功能有关。阴维脉（E错），“阴维维于阴”，组合所有的阴经。